男，25岁，突感上腹部剧痛。检查：血压130/80mmHg，脉搏110次/分，板样腹，肠鸣音消失。血红蛋白120g/L，血白细胞数8.0×10⁹/L。以下提示病情危险的是
A. 恶心呕吐频繁
B. 体温持续升高，寒战
C. 脉搏加快，体温上升
D. 腹痛加重，大汗淋漓
E. 脉搏加快，体温下降

正确答案：E。脉搏加快，体温下降

解析：患者突感上腹部剧痛、板样腹（板样腹为消化道溃疡穿孔的特征性表现），肠鸣音消失，应考虑消化道溃疡穿孔。消化道穿孔时，由于大量胃内容物流入游离腹腔，可引起弥漫性腹膜炎。若脉搏加快、体温下降（E对），四肢阙冷，说明已经发生革兰阴性菌脓毒症、感染性休克，是病情危重的表现之一。恶心呕吐频繁是腹胀严重的表现（A错）；体温持续升高、寒战（B错），脉搏加快、体温上升（C错）说明感染加重；腹痛加剧，大汗淋漓（D错）表明腹膜刺激征严重，但以上均不是病情危重的表现。